关于碘伏，哪种说法是错误的
A. 是碘与表现活性剂的不定型结合物
B. 可配成水或乙醇溶液使用，乙醇溶液杀菌作用更强
C. 可杀灭各种细菌繁殖体
D. 对细菌芽胞、真菌和病毒杀灭作用较差
E. 器械消毒应以1～2mg/ml有效碘浓度浸泡1～2h

正确答案：D。对细菌芽胞、真菌和病毒杀灭作用较差

解析：本题考查碘伏。关于碘伏错误的是对细菌芽胞、真菌和病毒杀灭作用较差（D错，为本题的正确答案）。碘伏作为一种化学消毒剂，杀菌谱广、毒性低、无刺激性、性能稳定、无腐蚀性、作用速度快，是碘与表面活性剂的不定型结合物（A对）。碘伏可配成水或乙醇溶液使用，乙醇溶液杀菌作用更强（B对）。可杀灭各种细菌繁殖体（C对）与芽孢，以及真菌和病毒。器械消毒应以1～2mg/ml有效碘浓度浸泡1～2h（E对）。